5岁男孩，突发寒战，体温39℃，右膝部疼痛剧烈，不敢活动，局部无明显肿胀。应首先考虑的是
A. 慢性骨髓炎
B. 化脓性关节炎
C. 类风湿性关节炎
D. 急性血源性骨髓炎
E. 胫骨结节骨软骨病

正确答案：D。急性血源性骨髓炎

解析：5岁患儿，突发寒战、体温39℃（提示可能存在感染），右膝部疼痛剧烈（提示感染部位可能在膝部），不敢活动、局部无明显肿胀（提示感染病灶较深），结合患者症状和体征，应首先考虑的是急性血源性骨髓炎（D对）。慢性骨髓炎（P742）（A错）由急性血源性骨髓炎迁延不愈演变而来，全身症状多不明显。化脓性关节炎（P746）（B错）病变位于膝关节时多有明显肿胀，且可有浮髌试验阳性。类风湿性关节炎（P766）（C错）多见于女性，常累及手足等小关节，很少累及大关节，不会出现寒战高热等表现。胫骨结节软骨病（P713）（E错）常见于12～14岁好动男孩，常有剧烈运动史，表现为胫骨结节明显隆起，皮肤无炎性改变。